室内空气中哪项的含量是评价空气清洁度的一个重要指标，也是判断居室容积是否符合卫生要求的重要指标之一
A. CO₂
B. HCHO
C. VOCs
D. ²²²Rn
E. B（a）P

正确答案：A。CO₂

解析：本题考查评价空气清洁度和判断居室容积是否符合卫生要求的指标。室内空气中CO₂（A对BCDE错）的含量是评价空气清洁度的一个重要指标，也是判断居室容积是否符合卫生要求的重要指标之一。室内空气中有害物质的浓度随CO₂浓度的增加而增加，当CO₂浓度达0.07%时，空气的其他性状出现变化，敏感的人会感到不良气味并有不适的感觉。当CO₂浓度达0.1%时，空气的其他性状开始恶化，出现显著的不良气味，人们普遍地感觉不舒适。